物料在定子和转子间的缝隙受剪切作用而制成混悬剂或乳剂的设备
A. 球磨机
B. 气流式粉碎机
C. V型混合机
D. 冲击式粉碎机
E. 胶体磨

正确答案：E。胶体磨